在下列选项中，对诊断左心室衰竭最有价值的体征是
A. 第一心音减弱
B. 肺部湿啰音
C. 收缩中期喀喇音
D. 舒张期奔马律
E. 肺动脉瓣区第二心音亢进

正确答案：D。舒张期奔马律

解析：左心室衰竭患者心率增快，肺动脉瓣区第二心音亢进及舒张期奔马律。第一心音减弱常见于低血压、主动脉瓣狭窄、肺动脉瓣狭窄等。肺部湿啰音可见于左心室衰竭，但也可见于肺部感染，无特异性。收缩中期喀喇音常见于二尖瓣脱垂。掌握“心力衰竭”知识点。